桑菊感冒片除疏风清热外，又能
A. 益气固表
B. 发汗解表
C. 解表清热
D. 宣肺止咳
E. 止泻止痢

正确答案：D。宣肺止咳

解析：本题考查的是桑菊感冒片的功能。桑菊感冒片除疏风清热外，又能宣肺止咳（D对）。桑菊感冒片：【功能】疏风清热，宣肺止咳。固本咳喘片：【功能】益气固表（A错），健脾补肾。表实感冒颗粒：【功能】发汗解表（B错），祛风散寒。感冒清热颗粒：【功能】疏风散寒，解表清热（C错）。止泻止痢（E错）为清热燥湿止泻剂的功能。清热燥湿止泻剂主要具有清热燥湿、止泻止痢等作用，主治大肠湿热所致的泄泻、痢疾，症见腹泻、腹痛、里急后重、便利脓血，或泄泻、暴注下迫、腹痛、便下酸腐灼肛，舌红苔黄腻、脉滑数等。